对多氯联苯的描述，下列哪项是不正确的
A. 具有耐酸、耐碱、耐腐蚀、绝缘等优良性能
B. 可对机体的心脑血管系统产生严重损害
C. 易于发生生物富集作用
D. 具有雌激素样作用
E. 在环境中非常稳定，易附着于颗粒物上沉积于底泥中

正确答案：B。可对机体的心脑血管系统产生严重损害

解析：本题考查多氯联苯的相关内容。多氯联苯是由氯置换联苯分子中的氢原子而形成的一类含氯化合物，具有耐酸、耐碱、耐腐蚀、绝缘等优良性能（A对），具有雌激素样作用（D对），容易发生生物富集作用（C对）。多氯联苯在环境中非常稳定，易于附着于颗粒物上沉积于底泥中（E对）。多氯联苯对皮肤、牙齿、神经行为、免疫功能、肝脏有影响（B错，为本题正确答案），且具有生殖毒性和致畸性、致癌性。